牛黄清心丸既清热解毒，又能
A. 止痉安神
B. 镇惊开窍
C. 镇惊安神
D. 平肝潜阳

正确答案：C。镇惊安神

解析：本题考查牛黄清心丸的功能。牛黄清心丸既清热解毒，又能镇惊安神（C对）。万氏牛黄清心丸【功能】清热解毒，镇惊安神。紫雪散【功能】清热开窍，止痉安神（A错）。安宫牛黄丸（胶囊、散）【功能】清热解毒，镇惊开窍（B错）。脑立清丸（胶囊）【功能】平肝潜阳（D错），醒脑安神。冰片【功效】开窍醒神（E错），清热止痛。